开办药品零售企业的审查批准部门
A. 卫生部
B. 国家医药管理局
C. 两者均是
D. 两者均不是

正确答案：D。两者均不是

解析：本题考查开办药品零售企业的审查批准部门。开办药品零售企业的审查批准部门是县级药品监督管理机构（D对）。开办药品零售企业，申办人应当向拟办企业所在地设区的市级药品监督管理机构或者省、自治区、直辖市人民政府药品监督管理部门直接设置的县级药品监督管理机构提出申请。受理申请的药品监督管理机构应当自收到申请之日起30个工作日内，依据国务院药品监督管理部门的规定，结合当地常住人口数量、地域、交通状况和实际需要进行审查，作出是否同意筹建的决定。申办人完成拟办企业筹建后，应当向原审批机构申请验收。原审批机构应当自收到申请之日起15个工作日内，依据《药品管理法》第十五条规定的开办条件组织验收；符合条件的，发给《药品经营许可证》。